不支持急性脑器质性精神障碍诊断的表现是
A. 幻视
B. 错觉
C. 注意涣散
D. 意识清晰
E. 定向障碍

正确答案：D。意识清晰

解析：急性脑器质性障碍（急性脑病综合征）多以意识障碍（D错，为本题正确答案）为主要特征。其特征包括：1.意识障碍：为主要特征，有明显的昼夜节律变化，表现为昼轻夜重；2.感知障碍：错觉（B对）和幻觉，以视错觉和视幻觉（A对）较常见；3.注意障碍：注意涣散（C对），表现为注意力不集中；4.定向障碍（E对）：对周围环境与事物的觉察清晰度降低。